男性，55岁。机关干部。患胃溃疡多年，本次因胃出血入院，手术治疗后，病情平稳。此时，医患关系模式为
A. 共同参与型
B. 指导-合作型
C. 被动-主动型
D. 主动-主动型
E. 主动-被动型

正确答案：B。指导-合作型